PAR的计算公式是
A. It（人群发病率）﹣Iu（非暴露组发病率）
B. Ie（暴露组发病率）﹣Iu（非暴露组发病率）
C. Ie/Iu
D. （RR-1）/RR×100%
E. Pe（RR﹣1）/[Pe（RR﹣1）﹢1]×100%

正确答案：A。It（人群发病率）﹣Iu（非暴露组发病率）